下述哪项与痛经无关
A. 子宫内膜异位症
B. 子宫腺肌瘤
C. 子宫颈管狭窄
D. 盆腔炎症
E. 无排卵型功血

正确答案：E。无排卵型功血

解析：前列腺素含量增高是造成痛经的主要原因。无排卵性功血的增生期子宫内膜因无孕酮刺激，所含前列腺素浓度很低，通常不发生痛经。掌握“功能失调性子宫出血”知识点。